少尿型急性器质性肾衰竭少尿期时，下述哪项尿变化是与诊断不相符合的?
A. 尿比重固定
B. 尿/血肌酐比值＞40:1
C. 肾率指数＞1
D. 尿钠含量＞40mmol/L
E. 尿渗透压＜350mOsm/L

正确答案：B。尿/血肌酐比值＞40:1

解析：器质性肾衰竭少尿期尿液变化：尿比重常固定（A对），＜1.015；尿渗透压＜350mOsm/L（E对）；尿钠含量＞40mmol/L（D对）；尿/血肌酐比值＞40:1（B错，为本题正确答案）；肾率指数＞1（C对）。